具有化湿和胃、宁神益智功效的药物是
A. 牛黄
B. 麝香
C. 冰片
D. 苏合香
E. 石菖蒲

正确答案：E。石菖蒲

解析：石菖蒲辛开苦燥温通，芳香走窜，具有开窍醒神，化湿，豁痰，辟秽之功；；入心经，开心窍，具有醒神益智、聪耳明目之功；气味芳香，具有化湿醒脾开胃之功（E对）。牛黄性凉，气味芳香，入心经，既能清心热，又能豁痰开窍而苏醒神志；有清心凉肝、息风止痉之功；为清热解毒之良药（A错）。麝香辛香温通，走窜之性甚烈，有极强的开窍通闭之功，可用于各种原因所致的闭证神昏，为醒神回苏之要药；可行血中之瘀滞，开经络之塞遏，具有活血通经、止痛之功；有良好的活血散结，消肿止痛作用，内服、外用均可（B错）。冰片味辛气香，有开窍醒神之功效，功似麝香但力较弱，二者常相须为用；入心经，止心痛，用治冠心病心绞痛；有良好的泻火解毒、清热止痛之功；有清热解毒、防腐生肌作用（C错）。苏合香辛香气烈，有开窍醒神之效，作用与麝香相似而力稍逊，且长于温通、辟秽，故为治面青、身凉、苔白、脉迟之寒闭神昏的要药（D错）。